在饮食养生中，饮食三宜是指
A. 食宜少，食宜凉，食宜细嚼细咽
B. 食宜少，食宜淡
C. 食宜少，食宜甜
D. 食宜咸，食宜润
E. 食宜软，食宜温，食宜细嚼细咽

正确答案：E。食宜软，食宜温，食宜细嚼细咽

解析：饮食是人赖以生存和维持健康的基本条件，是人体生命活动所需精微物质的重要来源。饮食失宜会内伤脾胃，影响健康，所以饮食应宜软、宜温、宜细嚼慢咽（E对ABCD错）。